吐温类溶血作用由大到小的顺序为
A. 吐温80＞吐温40＞吐温60＞吐温20
B. 吐温20＞吐温60＞吐温40＞吐温80
C. 吐温80＞吐温60＞吐温40＞吐温20
D. 吐温20＞吐温40＞吐温60＞吐温80
E. 吐温20＞吐温80＞吐温40＞吐温60

正确答案：B。吐温20＞吐温60＞吐温40＞吐温80

解析：本题考查表面活性剂。溶血作用的顺序：聚氧乙烯烷基醚＞聚氧乙烯芳基醚＞聚氧乙烯脂肪酸酯＞吐温20＞吐温60＞吐温40＞吐温80（B对）。